关于黄斑的描述，正确的是
A. 位于视神经乳头(盘)颞侧约3.5mm处
B. 中央有视网膜中央动脉穿出
C. 其中央凹陷称中央凹,感光作用最敏锐，但无辨色能力
D. 此处无感光细胞，称为生理性盲点
E. 视网膜节细胞轴突由此向后穿出眼球壁

正确答案：A。位于视神经乳头(盘)颞侧约3.5mm处

解析：黄斑位于视神经乳头(盘)颞侧约3.5 mm处（A对），其中央凹陷由密集的视锥细胞构成，故感光作用最敏锐，且有辨色能力（C错）。中央有视网膜中动脉穿出（B错）和无感光细胞，称为生理性盲点（D错）的是视神经盘，而非黄斑。视网膜节细胞轴突由视神经盘向后穿出眼球壁（E错），而非黄斑。